由于某焦化厂工业废水事故性排放污染了水源地，经过水厂常规消毒处理后其饮水中具有不良的臭味，据此认为产生臭味的污染物是
A. 氰化物
B. 酚
C. 多氯联苯
D. 有机酸
E. 硫化氢

正确答案：B。酚

解析：本题考查水体污染物。酚类化合物是一类挥发性有机物，具有较强的臭味，其挥发性使它们能够在空气中悬浮，从而影响周围空气的质量，并且它们的挥发性也使它们能够溶解在水中，从而影响水的质量。因此，酚类（B对ACDE错）化合物是一类常见的污染物，它们可以通过工业废水排放进入水源地，并且在水厂消毒处理后仍然能够残留在水中，从而产生臭味。